女，40岁。近4年来逐渐出现活动后心悸气短。查体：心尖部可闻及舒张期隆隆样杂音。进一步查体发现心尖部S₁亢进，可闻及开瓣音，提示
A. 病变瓣膜弹性良好
B. 病变瓣膜钙化
C. 肺动脉高压
D. 肺淤血
E. 病变瓣膜赘生物形成

正确答案：A。病变瓣膜弹性良好

解析：患者中年女性，有活动后心悸气短症状，查体：心尖部可闻及舒张期隆隆样杂音（二尖瓣狭窄特征性杂音），考虑诊断为二尖瓣狭窄。二尖瓣狭窄时心尖部S₁亢进，可闻及开瓣音，常提示病变瓣膜弹性良好（A对）。如瓣叶钙化僵硬（B错），则该体征消失。P₂（第二心音的肺动脉瓣部分）亢进和分裂提示肺动脉高压（C错）。肺淤血（D错）与开瓣音的产生无关。病变瓣膜赘生物形成（E错）常见于感染性心内膜炎。